下列除哪项外，其他均属于腰麻（蛛网膜下腔阻滞）术后的并发症
A. 尿潴留
B. 呼吸抑制
C. 颅神经麻痹
D. 马尾丛综合征
E. 脓性脑脊膜炎

正确答案：B。呼吸抑制

解析：蛛网膜下腔阻滞的术后并发症为头痛、尿潴留（A对）、颅神经麻痹（C对）、粘连性蛛网膜炎、马尾丛综合征（D对）、化脓性脑脊膜炎（E对）、下肢瘫痪等，术后并发症中没有呼吸抑制（B错，为本题正确答案），呼吸抑制属于术中并发症。